在黏膜局部抗感染免疫防御中发挥关键作用的是
A. SIgA
B. IgG
C. IgE
D. IgM
E. IgD

正确答案：A。SIgA